环境内分泌干扰物的英文缩写是
A. ECD
B. CDE
C. EDC
D. EED
E. EDB

正确答案：D。EED

解析：本题考查环境内分泌干扰物。环境内分泌干扰物即environmental endocrine disruptors，英文缩写是EED（D对ABE错），它是指可通过干扰生物或人体内保持自身平衡和调节发育过程天然激素的合成、分泌、运输、结合、反应和代谢等过程从而对生物或人体的生殖、神经和免疫系统等的功能产生影响的外源性化学物质。（endocrine disrupting chemicals，EDC）（C错）为内分泌干扰化学物的英文缩写。